来源于天然植物，长期使用会产生骨髓抑制毒副作用的抗痛风药物是
A. 丙磺舒
B. 苯溴马隆
C. 别嘌醇
D. 秋水仙碱
E. 盐酸赛庚啶

正确答案：D。秋水仙碱

解析：本题考查秋水仙碱。秋水仙碱（D对）长期使用会产生骨髓抑制毒性副作用；丙磺舒（A错）可用于慢性痛风的治疗；苯溴马隆（B错）为促尿酸排泄药；别嘌醇（C错）能够抑制尿酸生成，无骨髓毒性；盐酸赛庚啶（E错）能够治疗过敏疾病。